以下药物中应检查的特殊杂质是：黄体酮
A. 游离水杨酸
B. 游离肼
C. 洋地黄皂苷
D. 其他甾体
E. 酮体

正确答案：D。其他甾体